蔬菜水果的主要卫生问题不包括
A. 细菌及寄生虫的污染
B. 农药污染
C. 工业废水中有机化学物质的污染
D. 霉菌及霉菌毒素污染
E. 其他有害物质如硝酸盐和亚硝酸盐的污染

正确答案：D。霉菌及霉菌毒素污染